男，68岁，发热，干咳，全身肌肉酸痛，胸片显示：双肺磨玻璃影，大部分融合。此时，患者首选的检查是
A. 病原抗原检测
B. 病原抗体检测
C. 痰培养
D. 核酸检测
E. 血培养，药敏

正确答案：A。病原抗原检测

解析：患者男，68岁，发热，干咳，全身肌肉酸痛，胸片显示：双肺磨玻璃影，大部分融合，结合患者的表现，诊断为间质性肺疾病。结合实际情况，患者应首选病原抗原检测（A对）。病原抗原检测是检测病毒的结构蛋白。病原抗体检测主要用于观察疗效的检测指标。痰培养可诊断呼吸道感染性疾病，结合药敏试验，可指导用药。对于菌血症、败血症和真菌血症导致的发热，血培养是检测血流感染的基本实验（BCDE错）。